以谷类为原料的蒸馏酒，甲醇不得超过
A. 0.02g/100ml
B. 0.04g/100ml
C. 0.08g/100ml
D. 0.12g/100ml
E. 0.16g/100ml

正确答案：B。0.04g/100ml